龋发生的重要因素
A. 细菌的存在
B. 牙齿钙化不良
C. 唾液分泌减少
D. 全身营养不良
E. 喜食甜食

正确答案：A。细菌的存在

解析：本题考查龋发生的重要因素。龋病是在以细菌为主的多种因素影响下，牙体硬组织发生慢性进行性破坏的一种疾病。致龋的多种因素包括细菌、食物、宿主和时间。其中，细菌是龋病发生的先决条件（A对），并且是龋病发生的必要条件。牙齿钙化不良（B错）有利于龋的发展；唾液分泌减少（C错），可引起口腔防御力降低，导致龋病的发生；全身营养不良（D错）导致免疫力降低，有利于龋病的发展；喜食甜食（E错）与龋的发生关系密切。